阳偏衰病机表现的临床证候是
A. 实寒证
B. 实热证
C. 虚寒证
D. 虚热证
E. 亡阳证

正确答案：C。虚寒证

解析：本题考查的是阴阳学说在疾病治疗中的应用。阳偏衰病机表现的临床证候是虚寒证（C对）。阴阳失调的基本病机是阴阳偏盛和阴阳偏衰。阴阳偏盛，又称“阴阳偏胜”，即阴或阳的过盛有余，为邪气有余之实证。阴阳偏盛的治疗原则是“损其有余”“实则泻之”。阳盛则热属实热证（B错），宜用寒凉药以制其阳，治热以寒，即“热者寒之”。阴盛则寒属实寒证（A错），宜用温热药以制其阴，治寒以热，即“寒者热之”。若其相对一方出现偏衰时，则当兼顾其不足，配合以扶阳或益阴之法。阴阳偏衰，即阴或阳的虚损不足，或为阴虚，或为阳虚。阴阳偏衰的治疗原则是“补其不足”“虚则补之”。阴虚不能制阳而致阳亢者，属虚热证（D错），一般不能用寒凉药直折其热，须“壮水之主，以制阳光”，即用滋阴壮水之法以抑制阳亢火盛，这种治疗原则亦称为“阳病治阴”。若阳虚不能制阴而造成阴盛者，属虚寒证，不宜用辛温发散药以散阴寒，须“益火之源，以消阴翳”，即用扶阳益火之法以消退阴盛，这种治疗原则也称为“阴病治阳”。亡阳证（E错），是指机体的阳气发生突然性脱失，而致全身功能突然严重衰竭的病机变化。